下列有关结核性淋巴结炎的相关叙述中，不正确的是
A. 淋巴结可有干酪样坏死
B. 常见于年老体弱人群
C. 轻者仅有淋巴结肿大而无全身症状
D. 可出现冷脓肿现象
E. 脓肿破溃后可形成经久不愈的窦或瘘

正确答案：B。常见于年老体弱人群

解析：结核性淋巴结炎常见于儿童及青年。轻者仅有淋巴结肿大而无全身症状；重者可伴体质虚弱、营养不良或贫血，或有低热、盗汗、疲倦等症状，并可同时有肺、肾、肠、骨等器官的结核病变或病史。掌握“面颈部淋巴结炎”知识点。